下列疾病除哪项外，均可见到周围血管征
A. 主动脉瓣关闭不全
B. 发热
C. 贫血
D. 甲亢
E. 主动脉瓣狭窄

正确答案：E。主动脉瓣狭窄

解析：周围血管征产生的主要原因是脉压增大，包括枪击音、Duroziez双重杂音和毛细血管搏动征，主要见于主动脉瓣关闭不全（A对）、发热（B对）、严重贫血（C对）、和甲状腺功能亢进症（D对）。主动脉瓣狭窄（E错，为本题正确答案）脉搏细弱而缓慢，收缩压降低，舒张压正常，脉压差变小，故无周围血管征。